某糖尿病患者伴有浸润性肺结核，应用甲苯磺丁脲，利福平，链霉素，用抗结核药两月后，尿糖加重并出现肝功能不良，其原因是
A. 甲苯磺丁脉有肝毒性
B. 患者又患了肝炎
C. 利福平诱导肝药酶且有肝损害
D. 链霉素的肾毒性
E. 以上都不是

正确答案：C。利福平诱导肝药酶且有肝损害